肺实变时触诊可出现
A. 气管偏向健侧，语音震颤减弱
B. 气管偏向健侧，语音震颤增强
C. 气管偏向患侧，语音震颤减弱
D. 气管居中，语音震颤增强
E. 气管居中，语音震颤减弱

正确答案：D。气管居中，语音震颤增强

解析：肺实变时，胸腔内纵膈两侧并无明显压力差，气管保持居中；声波传导良好，语颤增强（D对）。大量气胸或胸腔积液时，气管向健侧移位；肺不张时气管向患侧移位。阻塞性肺疾病、阻塞性肺不张、大量气胸或胸腔积液、胸膜粘连增厚和胸膜皮下气肿时，语音震颤减弱。